肺通气的原动力来自
A. 肺内压与胸膜腔内压之差
B. 肺内压与大气压之差
C. 肺的弹性回缩
D. 呼吸肌的舒缩运动
E. 肺内压的周期性变化

正确答案：D。呼吸肌的舒缩运动

解析：肺通气是气体流动的进出肺的过程，要实现肺通气，必须在肺泡与外界环境之间存在一定压力差。在一定的海拔高度，大气压是相对恒定的，因此肺泡与外界环境之间的压力差是由肺泡内的压力（肺内压）决定的。肺内压的周期性变化（E错）取决于肺的扩张和缩小（C错），其扩张和缩小依赖于呼吸肌的收缩和舒张引起的胸廓运动。因此，肺通气的原动力是呼吸肌的舒缩活动（D对）；肺通气的直接动力是肺内压与大气压之差（B错）。肺内压与胸膜腔内压之差（A错）即跨肺压，其是指肺泡壁内外的压力差。